肠溶性包衣材料是
A. CAP
B. EC
C. PEG400
D. HPMC
E. CMC-Na

正确答案：A。CAP

解析：本题考查片剂的包衣。CAP（醋酸纤维素酞酸酯）（A对）在胃中不溶，可在肠液中溶解，为肠溶型包衣材料；EC（乙基纤维素）（B错）为不溶性包衣材料；PEG400（C错）不用作包衣材料；HPMC（D错）为胃溶型包衣材料；CCMC-Na（交联羧甲基纤维素钠）（E错）为崩解剂。